男孩，1岁。发热伴咳嗽3天，食欲差。偶有呕吐，嗜睡，抽搐2次，双肺可闻及中细湿啰音，心率110次/分，呼吸56次/分，肝肋下1cm，白细胞4×10⁹/L。高热不退，呈驰张型，出现面色苍白。首选的检查
A. 痰培养
B. 胸部X线片
C. 心电图
D. 血常规
E. 血气分析

正确答案：B。胸部X线片

解析：患儿发热、咳嗽、双肺闻及中细湿啰音、呼吸频率增快，应诊断为急性支气管肺炎。患儿嗜睡、抽搐、肝肿大，应考虑为重症支气管肺炎。为确诊急性支气管肺炎，当然首选胸部X线片检查（B对）。痰培养常用于细菌性肺炎、肺结核的辅助诊断（A错）。心电图常用于心律失常的诊断（C错）。血常规检查无特异性（D错）。血气分析常用于了解患儿酸碱失衡情况（E错）。